41岁男性，水泥厂车间工人。因常在夜间阵咳，咳脓性痰，并且在工作时呼吸困难，逐渐加重，前来就诊。查可见端坐时桶状胸，呼吸困难，病人自述感到气短、胸闷、并且在上楼梯时呼吸出现哮鸣音。听诊可闻及双肺干湿性啰音。实验室检查：FEV1/FVC＜70%及FEV1＜80%；RV/TLC增高，DLco及DLco/A下降；X线片显示双侧肺纹理增粗、紊乱或肺气肿改变。根据以上综合可以说明此患者的疾病为
A. 支气管哮喘
B. 慢性肺源性心脏病
C. 呼吸衰竭
D. 慢阻肺（COPD）
E. 慢性支气管炎

正确答案：D。慢阻肺（COPD）

解析：慢阻肺的临床表现：①常晨间慢性咳嗽或夜间阵咳，可有脓性痰；在劳力时逐渐加重的气短或呼吸困难，以致在日常活动甚至休息时也感到气短；特别是重度患者出现喘息；②出现桶状胸、可闻及干性啰音和（或）湿性啰音；③肺功能检查：是确定有无气流受限的重要检查。一秒钟用力呼气容积（FEV1）占用力肺活量（FVC）百分比（FEV1/FVC）＜70%及FEV1＜80%预计值、残气量/肺总量（RV/TLC）增高、一氧化碳弥散量（DLco）及DLco与肺泡通气量（A）比值（DLco/A）下降；④胸部X线检查：早期可无变化，随时间延长可出现肺纹理增粗、紊乱或肺气肿改变。掌握“慢性阻塞性肺疾病”知识点。